早孕出现最早及最重要的症状是
A. 尿频
B. 恶心呕吐
C. 停经史
D. 腹痛
E. 乳房胀痛

正确答案：C。停经史